三臂卡环卡环体的作用是
A. 恢复咬合关系
B. 防止基牙进倾斜移位
C. 防止义齿侧向和龈向移动
D. 应力中断
E. 防止食物嵌塞

正确答案：C。防止义齿侧向和龈向移动

解析：卡环体有稳定和支持义齿的作用，可防止义齿侧向和龈向移动。掌握“局部义齿固位体”知识点。